仅用于一般不进入无菌组织的器械灭菌的方法是
A. 高压蒸汽灭菌
B. 煮沸消毒法
C. 干热灭菌法
D. 化学消毒法
E. 紫外线消毒

正确答案：D。化学消毒法

解析：化学消毒法：医疗器械消毒，可用70%～80%乙醇浸泡，但仅用于一般不进入无菌组织的器械灭菌，浸泡时间为30分钟。掌握“口外消毒和灭菌”知识点。